围绝经期综合征肝郁化火型首选方为
A. 逍遥散
B. 丹栀逍遥散
C. 调肝汤
D. 柴胡疏肝散
E. 乌药汤

正确答案：B。丹栀逍遥散

解析：围绝经期综合征肝郁化火证的病机是肝郁日久，郁而化火；治宜疏肝解郁，清热调经；丹栀逍遥散（B对）有疏肝清热之功，切合病机。逍遥散（A错），具有调和肝脾，疏肝解郁，养血健脾之功效，主治肝郁血虚脾弱证。调肝汤（C错），具有补益肾水，平调肝气的功效，主治妇人肾水不足，肝气不舒，行经后少腹疼痛。柴胡疏肝散（D错）具有疏肝理气，活血止痛之功效，主治肝气郁滞证。乌药汤（E错），具有行气止痛的功效，主治血海疼痛。